真武汤与氢氯噻嗪联用
A. 缩短疗程
B. 降低毒性
C. 减少用量
D. 协同增效
E. 改善体质

正确答案：D。协同增效

解析：本题考查的是中西药合理联用的例举。真武汤与氢氯噻嗪（D对）。木防己汤、真武汤、越婢加术汤、分消汤等与西药利尿药联用，可以增强利尿效果。减少用量（C错）和降低毒性（B错）为柴胡桂枝汤与西药抗癫痫药联用的效果。柴胡桂枝汤等具有抗癫痫作用的中药复方与西药抗癫痫药联用，可减少抗癫痫药的用量及肝损害、嗜睡等副作用。联用可缩短疗程（A错）或改善体质（E错）的中西药药组，2022年考试指南未明确说明。